作业环境中影响工作效率的常见因素包括
A. 气温、颜色、噪声、轮班
B. 颜色、噪声、照明以及不合理姿势
C. 噪声、照明、高温以及缺少工间休息
D. 照明、颜色、轮班、高温
E. 颜色、噪声、照明、气温

正确答案：E。颜色、噪声、照明、气温